1～2岁幼儿1年中身高约增长
A. 5cm
B. 7cm
C. 10cm
D. 12cm
E. 13cm

正确答案：D。12cm

解析：身高（长）指头部、脊柱与下肢长度总和。正常足月儿出生时身高平均为50cm，第2年身长增长速度减慢，约10～12cm（ABE错），1岁时达75cm，2岁时约87cm，即1～2岁增长约12cm（D对）。